回力卡环具有应力中断作用的原因是
A. 远中（牙合）支托与基托相连，（牙合）力通过支托传导到基牙，减轻了牙槽嵴的负担
B. 远中（牙合）支托与基托相连，（牙合）力通过人工牙和基托传导到牙槽嵴，减轻了基牙的负担
C. 远中（牙合）支托不与基托相连，（牙合）力通过支托传导到基牙，减轻了牙槽嵴的负担
D. 远中（牙合）支托不与基托相连，（牙合）力通过人工牙和基托传导到牙槽嵴，减轻了基牙的负担
E. 远中（牙合）支托不与基托相连，（牙合）力通过人工牙和基托传导到牙槽嵴，减轻了牙槽嵴的负担

正确答案：D。远中（牙合）支托不与基托相连，（牙合）力通过人工牙和基托传导到牙槽嵴，减轻了基牙的负担

解析：回力卡环：常用于后牙游离端缺失，基牙为前磨牙或尖牙，牙冠较短或为锥形牙。卡环臂尖端位于基牙的唇（颊）面倒凹区，绕过基牙的远中面与支托相连接，再转向舌面的非倒凹区，在基牙近中舌侧通过连接体与腭（舌）杆相连：卡环臂尖端位于基牙舌面倒凹区时，与远中支托相连，转向近中颊侧通过连接体与基托相连者称反回力卡。两者均为铸造卡环，由于远中支托不与基托相连接，（牙合）力则通过人工牙和基托传到黏膜和颌骨上，减轻基牙的负荷，起应力中断的作用。掌握“局部义齿固位体”知识点。